全口义齿修复，前牙排列成浅覆（牙合）、浅覆盖及前牙不接触的目的是
A. 美观
B. 排牙方便
C. 易于取得前伸（牙合）平衡
D. 发音清晰
E. 与天然牙一致

正确答案：C。易于取得前伸（牙合）平衡

解析：本题考查全口义齿排牙的原则。全口义齿修复，前牙排列成浅覆（牙合）、浅覆盖及前牙不接触的目的是易于取得前伸（牙合）平衡（C对）。前牙要排列成浅覆（牙合）、浅覆盖，正中咬合时前牙不接触，易于达到前伸平衡（牙合）。并在前伸及侧方运动时至少在1mm的范围内，下颌牙沿上颌牙斜面自由滑动。